患者女，45岁。久病崩漏，大便秘结，数天一行，面色无华，唇甲色淡，头晕心悸，舌淡，脉细。治疗选用的最佳方剂为
A. 麻子仁丸
B. 更衣丸
C. 归脾汤
D. 润肠丸
E. 五仁丸

正确答案：D。润肠丸

解析：本题为便秘虚秘患者血虚津少，不能下润大肠，肠道干涩，故大便秘结；血虚不能上荣故面色无华，唇甲色淡，头晕；心血不足故心悸；舌淡，脉细都表示阴血不足，应当养血润燥，滋阴通便，用润肠丸（D对）加减。麻子仁丸（A错）用于肠胃积热以泻热导滞，润常通便。更衣丸（B错）用于热秘。归脾汤（C错）一般用于心血不足之失眠。五仁丸（E错）用于血虚便秘之阴血已复但大便仍然干燥。